利福平抗菌作用机制是
A. 抑制RNA聚合酶
B. 抑制二氢叶酸还原酶
C. 抑制二氢叶酸合成酶
D. 抑制拓扑异构酶Ⅳ
E. 抑制肽酰基转移酶

正确答案：A。抑制RNA聚合酶

解析：本题考查药物的作用机制。利福平抗菌作用机制是抑制RNA聚合酶（A对）。利福平的抗菌作用机制：抑制病原体依赖DNA的RNA聚合酶，与敏感菌依赖DNA的RNA聚合酶β亚单位牢固结合，抑制病原体RNA合成的起始阶段，抑制细菌RNA的合成。抑制二氢叶酸还原酶（B错）是甲氨蝶呤的作用机制。抑制二氢叶酸合成酶（C错）是磺胺类药物的作用机制。抑制拓扑异构酶Ⅳ（D错）是喹诺酮类药物的作用机制。抑制肽酰基转移酶（E错）是氯霉素的作用机制。